病人义务应除外
A. 完全听从医师安排
B. 如实提供病情信息
C. 认真执行医嘱
D. 不将疾病传播他人
E. 尊重医师及其劳动

正确答案：A。完全听从医师安排

解析：患者的道德义务就是在医疗活动中，患者应履行的道德义务主要有：①配合医者诊疗的义务；②遵守医院规章制度，尊重医务人员及其劳动的义务；③给付医疗费用的义务；④保持和恢复健康的义务；⑤支持临床实习和医学发展的义务。掌握“医患关系伦理”知识点。